初产妇，29岁。妊娠41周，枕右前位，骨盆测量正常，宫口开全1小时，胎心88次/分，胎头S+3。在吸氧同时，最恰当的处理措施是
A. 应用前列腺素加强宫缩
B. 等待自然分娩
C. 立即行剖宫产术
D. 产钳助产术
E. 静脉滴注缩宫素

正确答案：D。产钳助产术

解析：青年初产妇，妊娠41周，胎位正常，骨盆测量正常，宫口开全1小时（已进入第二产程，初产妇需1～2小时），胎头S＋3（胎头≥＋3，可阴道试产），胎心88次/分（正常值110～160次/分），提示发生胎儿严重缺氧，应行产钳助产（D对B错）尽快结束分娩。当短时间内不能经阴道分娩者，应立即行剖宫产术（C错）。应用前列腺素加强宫缩（A错）及静脉滴注缩宫素（E错），可用于足月妊娠（37～42周）的引产，其助产效果不如产钳助产和胎头吸引术。